关于紫外光照射引起DNA分子形成的TT二聚体，下列叙述哪项正确
A. 并不终止复制
B. 由光修复酶断裂两个胸腺嘧啶形成的二聚体
C. 由胸腺嘧啶二聚体酶所催化
D. 由两股互补核苷酸链上胸腺嘧啶之间形成共价键
E. 框移码突变阅读

正确答案：B。由光修复酶断裂两个胸腺嘧啶形成的二聚体